某食堂6月份供应蛋炒饭，引起近百人食物中毒。发病潜伏期约8小时，以腹痛、腹泻为主要症状，不发热，病程为16~36小时，预后良好。经卫生学调查发现，蛋炒饭所用的米饭是前一天的剩饭。其中毒机制为
A. 细菌活菌
B. 细菌内毒素
C. 细菌肠毒素
D. 细菌活菌加内毒素
E. 细菌活菌加肠毒素

正确答案：E。细菌活菌加肠毒素